以口腔黏膜继发性溃疡为特征表现的疾病是
A. 慢性唇炎
B. 维生素A缺乏
C. 口角炎
D. 单纯疱疹
E. 地图舌

正确答案：D。单纯疱疹

解析：本题考查单纯疱疹。以口腔黏膜继发性溃疡为特征表现的疾病是单纯疱疹（D对）。单纯疱疹水疱期时表现为在口腔黏膜任何部位皆可发生成簇小水疱，水疱泡壁薄、透明，不久溃破，形成浅表溃疡；慢性唇炎的临床表现主要以脱屑、渗出糜烂为主（A错）；维生素A缺乏的特征为皮肤干燥，四肢伸面有非炎性的棘刺状毛囊丘疹，伴以眼部症状如眼干燥、结膜皱摺等（B错）；口角炎是发生于上下唇两侧联合处口角区的炎症总称，以皲裂、口角糜烂和结痂为主要症状（C错）；地图舌主要表现为中央区剥脱性红斑，周围区丝状乳头增厚呈带状或弧线分布（E错）。